影响生物地球化学性疾病流行的主要因素有
A. 环境污染物排放增多
B. 生物性病原体的传播
C. 生活习惯
D. 卫生习惯
E. 以上都不是

正确答案：C。生活习惯

解析：本题考查影响生物地球化学性疾病流行的因素。生物地球化学性疾病是由于地壳表面化学元素分布的不均匀性，使某些地区的水和（或）土壤中某些元素过多或过少，当地居民通过饮水、食物等途径摄入这些元素过多或过少，而引起某些特异性疾病。影响生物地球化学性疾病流行的主要因素有：1.营养条件：在生物地球化学性疾病的流行区，人们生活条件和营养状况的改善，可降低流行强度。2.生活习惯（C对ABDE错）：以往的研究表明，元素过高所引起的生物地球化学性疾病，其病区类型以饮水型氟中毒和砷中毒为主。但是20世纪60年代以来，相继发现并报告了燃煤污染型氟中毒和砷中毒的病例。我国贵州、四川、广西、湖南、湖北和陕西等12个省区的150个县，分布着燃煤污染型地方性氟中毒病区；而四川和贵州也有燃煤污染所致的砷中毒病例报导。饮茶型氟中毒是近年来在我国西藏、内蒙古、四川等少数民族地区发现的，当地居民习惯饮用奶茶，煮奶茶的茶叶主要为砖茶。3.多种元素的联合作用：在生物地球化学性疾病的防治工作中发现，一些地区存在着两种或两种以上疾病，从而加重了防治工作的复杂性。例如在某些深山里面的地方性氟中毒病区，同时存在着碘缺乏病；在碘缺乏病流行病区，往往存在着与硒缺乏有关的大骨节病、克山病。这种高氟与低碘、高氟与低硒、高氟与高砷、低碘与低硒并存的地质环境，增加了人群健康影响的复杂性。